下列关于口腔颌面部肿瘤手术治疗的论述中，不恰当的是
A. 手术目前仍是治疗口腔颌面肿瘤主要和有效的方法
B. 对可能有淋巴结转移的恶性肿瘤，还应将其所属区域的淋巴组织彻底清除
C. 手术治疗适用于良性肿瘤
D. 手术治疗适用于用放射线及化疗不能治愈的恶性肿瘤
E. 肿瘤切除不彻底，复发后再次手术，能获得满意的疗效

正确答案：E。肿瘤切除不彻底，复发后再次手术，能获得满意的疗效

解析：手术目前仍是治疗口腔颌面肿瘤主要和有效的方法，适用于良性肿瘤或用放射线及化疗不能治愈的恶性肿瘤。手术时必须遵循肿瘤外科原则。对恶性肿瘤必须完全、彻底切除。对可能有淋巴结转移的恶性肿瘤，还应将其所属区域的淋巴组织彻底清除。临床上一般称为“根治术”，因为第一次手术常是治愈肿瘤的关键，如切除不彻底，容易复发，再次手术则常不能获得满意的疗效。掌握“口腔颌面部肿瘤的治疗原则及预防”知识点。